炎症刺激使宫颈间质组织充血、水肿、腺体和纤维组织增生
A. 宫颈糜烂
B. 宫颈息肉
C. 宫颈肥大
D. 宫颈腺体囊肿
E. 慢性宫颈管炎

正确答案：C。宫颈肥大

解析：炎症刺激使宫颈间质组织充血、水肿、腺体和纤维组织增生会导致宫颈肥大（C对）。宫颈糜烂（A错）为子宫颈柱状上皮异位，可为生理性改变也可为病理性改变（P256）。宫颈息肉（B错）是子宫颈管腺体和间质的局限性增生，并向子宫颈外口突出（P256）。宫颈腺体囊肿（D错）为子宫颈转化区内鳞状上皮取代柱状上皮过程中，新生的鳞状上皮覆盖子宫颈腺管口或伸人腺管，将腺管口阻塞，导致腺体分泌物引流受阻潴留而形成（P256）。慢性宫颈管炎（慢性子宫颈管黏膜炎）（E错）为子宫颈管粘液及脓性分泌物反复发作（P255-P256）。